癫痫患者，发则突然跌仆，目睛上视，口吐白沫，手足抽搐，喉间痰鸣，舌苔白腻，脉弦滑。治疗应首选的方剂是
A. 醒脾汤
B. 黄连温胆汤
C. 龙胆泻肝汤合涤痰汤
D. 左归丸
E. 定痫丸

正确答案：E。定痫丸

解析：本病为痫证患者，用定痫丸（E对）开窍醒神，涤痰熄风。醒脾汤（A错）用于脾虚痰湿证以健脾和胃，化痰熄风。黄连温胆汤（B错）用于治疗失眠等病，功效为清热燥湿，化痰和中。龙胆泻肝汤合涤痰汤（C错）适用于肝火痰热证以清泻肝火，化痰宁心。左归丸（D错）适用于肝肾阴虚证以补益肝肾，育阴熄风。